屈肘关节的肌肉，主要是
A. 肱二头肌
B. 肱肌
C. 缘肱肌
D. 肱三头肌
E. 无

正确答案：A。肱二头肌

解析：肱二头肌（A对）屈肘关节，使前臂旋后，并协助屈肩关节。肱肌（B错）也屈肘关节，但不占主导地位。缘肱肌（C错）使肩关节屈和内收。肱三头肌（D错）伸肘关节，并协助肩关节伸及内收。